某男，78岁。喘促日久，呼多吸少，气不得续，动则喘甚，形瘦神疲，汗出肢冷，舌淡，苔薄，脉沉。宜选用的中成药是
A. 小青龙合剂
B. 养阴清肺丸
C. 清肺化痰丸
D. 补金片
E. 百合固金丸

正确答案：D。补金片

解析：本题考查的是喘证的辨证论治。喘促日久，呼多吸少，气不得续，动则喘甚，形瘦神疲，汗出肢冷，舌淡，苔薄，脉沉。宜选用的中成药是补金片（D对）。喘即气喘、喘息。喘证是以呼吸困难，甚至张口抬肩、鼻翼扇动、不能平卧为特征的疾病。西医学的肺炎、支气管炎、肺气肿、肺源性心脏病、心源性哮喘以及癔病等发生呼吸困难时，可参考此内容辨证论治。（一）风寒闭肺证：【症状】喘咳气逆，呼吸急促，胸部胀闷，痰多色白稀薄而带泡沫，兼头痛鼻塞、无汗、恶寒、发热，舌苔薄白而滑，脉浮紧。【中成药应用】常用中成药有小青龙胶囊（A错）、风寒咳嗽颗粒、苓桂咳喘宁胶囊、桂龙咳喘宁胶囊。（二）痰热壅肺证：【症状】喘咳气涌，胸部胀痛，痰稠黏色黄，或夹血痰，伴胸中烦闷、身热、有汗、口渴喜冷饮、咽干、面红、尿赤、便秘。舌质红，苔薄黄腻，脉滑数。【中成药应用】常用中成药有清肺消炎丸、葶贝胶囊。（三）痰浊阻肺证：【症状】喘而胸满闷塞，甚则胸盈仰息，咳嗽，痰多黏腻色白，咳吐不利，兼有呕恶，食少，口黏不渴。舌苔白腻，脉滑或濡。【中成药应用】常用中成药有橘红痰咳颗粒、祛痰止咳颗粒。（四）肾不纳气证：【症状】喘促日久，动则喘甚，呼多吸少，气不得续，小便常因咳甚而失禁，或尿后余沥，形瘦神疲，汗出肢冷，面唇青紫，或有跗肿，舌淡苔薄，脉沉弱；或见喘咳，面红烦躁，口咽干燥，足冷，汗出如油。舌红少津，脉细数。【中成药应用】常用中成药有补金片。养阴清肺丸（B错）与百合固金丸（E错）为咳嗽肺阴亏耗证的中成药应用。咳嗽肺阴亏耗证：【症状】咳嗽日久，干咳少痰，或痰中带血，午后咳甚，或伴五心烦热，颧红，耳鸣，消瘦，神疲。舌质红，苔少，脉细数。【中成药应用】常用中成药有养阴清肺膏、百合固金丸、二冬膏。清肺化痰丸（C错）为咳嗽痰热郁肺证的中成药应用。咳嗽痰热郁肺证：【症状】咳嗽，气息粗促，或喉中有痰声，痰多，质黏稠色黄，或有腥味，难咳，胸胁胀满，或咳时引痛，面赤，或有身热，口干而黏，欲饮水。舌红，苔黄腻，脉滑数。【中成药应用】常用中成药有清肺化痰丸、清肺抑火丸、复方鲜竹沥液。